胃脘冷痛，牙龈红肿热痛，多见于
A. 表寒里热证
B. 表热里寒证
C. 上寒下热证
D. 上热下寒证
E. 真寒假热证

正确答案：D。上热下寒证

解析：患者牙龈红肿热痛，为上焦热证表现，同时存在胃脘冷痛的中焦脾胃虚寒证，故此患者属于上热下寒证（D对）。表寒里热证是指如先有表寒未罢，又入里化热，或先有里热之人，复感风寒之邪，出现恶寒发热、无汗、便秘尿黄等症（A错）。表热里寒证是指如素体阳气不足之人，复感风热之邪，出现发热恶寒、有汗、尿清便溏等症（B错）。上寒下热证如患者同时存上部脾胃虚寒证及下部膀胱湿热证的表现（C错）。真寒假热证是指疾病的本质为寒证，却出现某些“热象”，又称“寒极似热”（E错）。